关于郁金性能特点的说法，错误的是
A. 开窍辟秽
B. 辛行散
C. 苦泄降
D. 寒清凉
E. 走气走血

正确答案：A。开窍辟秽

解析：本题考查的是郁金的性能特点。郁金不能开窍辟秽（A错，为本题正确答案）。郁金：【性能特点】本品辛行散（B对），苦泄降（C对），寒清凉（D对），入心、肝、胆、肺经。走血走气（E对），既活血止痛，又疏肝行气解郁，还清心凉血而止血、醒神、利胆退黄，为活血行气凉血之要药。凡血瘀气滞有热、肝郁化火、血热出血、热扰心神及湿热郁闭心窍，皆可酌选。开窍辟秽为苏合香的性能特点。苏合香：【性能特点】本品芳香辛散，温通开郁，入心、脾经。既善辟秽开窍，治寒闭神昏；又能温散止痛，治胸痹腹痛。